男性，30岁。呼吸困难2天就诊，发作前有鼻痒、喷嚏。既往有类似病史。体检：呼吸20次/分，呼气末闻及哮鸣音，心率96次/分，律齐。为判断病情程度，应做哪项检查
A. 血嗜酸性粒细胞计数
B. 呼气流速峰值
C. 血清IgE
D. 血气分析
E. 胸部X线

正确答案：B。呼气流速峰值